妊娠期间摄入过量可导致新生儿血钙过高的是
A. 庆大霉素
B. 氯喹
C. 维生素D
D. 四环素
E. 甲硫咪唑

正确答案：C。维生素D